某正常健康成人，能量推荐摄入量为2100kcal，按照合理营养的要求，晚餐应摄取的能量为
A. 210kcal
B. 400kcal
C. 630kcal
D. 840kcal
E. 980kcal

正确答案：C。630kcal